需要检查高分子聚合物的是
A. 青霉素
B. 阿莫西林
C. 阿奇霉素
D. 庆大霉素
E. 四环素

正确答案：A、B。青霉素；阿莫西林

解析：本题考查抗生素类药物的分析。青霉素（A对）和阿莫西林（B对）为β-内酰胺类抗生素，本类抗生素的杂质主要有高分子聚合物、有关物质、异构体等，一般采用HPLC法控制其限量，也有采用测定杂质的吸光度来控制杂质量的。